以下关于主动-被动型医患关系的描述中正确的是
A. 医生是主动的，处权威地位，病人完全按医生的要求去做
B. 患者能充分发挥自己的主观能动性
C. 患者在医师指导下自己治疗
D. 医生的作用占优势，同时有限度地调动病人的主动性
E. 患者与医师有同等权力和主动性

正确答案：A。医生是主动的，处权威地位，病人完全按医生的要求去做

解析：主动-被动型这是一种最常见的单向性的，以生物医学模式为指导思想的医患关系，在现代医学实践中仍普遍存在，其特征为“医生为病人做什么”。在这种医患关系中，医生是主动的，在病人心目中处于权威地位，而病人则处于被动的地位，对医疗过程和措施不提任何意见，完全按医生的要求去做，听从医生的支配。这种模式主要适用于昏迷、休克、全麻、有严重创伤及精神病人的医疗过程，这种病人或失去意识或不能表达自己的要求，只能听命于医生的安排。由于这一模式病人没有自由意志，对医务人员的职业道德和临床经验要求很高，医务人员必须仔细观察、认真操作，才不致对病人造成伤害。掌握“医患沟通的理论、技术与其应用以及医患关系模式”知识点。